药品适用服药时间是
A. 早晨
B. 午夜
C. 睡前
D. 餐前
E. 餐后

正确答案：A、C、D、E。早晨；睡前；餐前；餐后

解析：本题考查药品服用的适宜时间。一般药品适宜服用的时间为清晨（A对）、餐前（D对）、餐中、餐后（E对）、睡前（C对），其中清晨服用的药物如糖皮质激素等，可减少对下丘脑-垂体-肾上腺皮质系统的反馈抑制，避免导致肾上腺皮质功能下降；餐前服用药物如胃黏膜保护药可以充分地黏附于胃壁，形成一层保护屏障；餐中服用的药物如降糖药和非甾体抗炎药等可减少对胃肠道的刺激；餐后服用的药物如西咪替丁等胃溃疡药物，可利用餐后胃排空延迟来延长药物的作用时间；催眠药和服用后易出现嗜睡反应的药可以在睡前服用。